居室空气中CO₂应保持在
A. 0.07%以上
B. 0.001
C. 0.1%以下
D. 0.07%以下
E. 7%以下

正确答案：D。0.07%以下

解析：本题考查居室中CO₂浓度的卫生学要求。室内空气中CO₂的含量是用作评价空气清洁度的一个重要指标，居室空气中CO₂浓度应保持在0.07%以下（D对ABCE错），即0.7L/m³。